盐酸氯丙嗪含量测定使用的滴定液是
A. 高氯酸滴定液
B. 溴酸钾滴定液
C. 硫酸铈滴定液
D. 硫代硫酸钠滴定液
E. 乙二胺四醋酸二钠滴定液

正确答案：A。高氯酸滴定液